患牙X线根尖片显示髓室壁边缘不规则，根管中1/3呈椭圆形扩大，可以诊断为
A. 急性牙髓炎
B. 慢性溃疡性牙髓炎
C. 牙内吸收
D. 牙髓钙化
E. 慢性增生性牙髓炎

正确答案：C。牙内吸收

解析：本题考查牙内吸收的X线片显示。患牙X线根尖片显示髓室壁边缘不规则，根管中1/3呈椭圆形扩大，可以诊断为牙内吸收（C对）。1.牙内吸收的乳牙一般无自觉症状，常常是用X线片来鉴别。牙内吸收的典型表现为髓室壁出现边缘不规则的透射区，根管内某部位呈圆形扩大，大范围的吸收显示出穿通牙齿的透射区或窝状透射区。2.牙髓钙化（D错）的X线片显示髓腔内有阻射的钙化物（髓石）或呈弥漫性阻射影像而致使原髓腔处的透射区消失。